30岁，男性，来自农村，发病4天，主要表现为发烧，出血，少尿，如果怀疑肾综合征出血热，最应做的化验是
A. 血常规
B. 尿常规
C. 便常规
D. 出凝血时间
E. 血、尿常规

正确答案：E。血、尿常规

解析：青年患者，发病4天（提示处于发热期），疑似肾综合征出血热，最应做的化验是血、尿常规（E对），血常规发病第3天白细胞开始升高，4-5天，淋巴细胞增多，并出现较多的异性淋巴细胞。尿常规病程第2天可出现尿蛋白，第4-6天尿蛋白明显增多。肾综合征出血热的便常规（C错）一般无异常。出凝血时间（D错）一般在低血压休克期才发生改变。